胫骨结节骨软骨病好发年龄是
A. 3～9岁
B. 10～11岁
C. 12～14岁
D. 15～17岁
E. 18～20岁

正确答案：C。12～14岁

解析：胫骨结节骨软骨病好发年龄是12～14岁（C对），常见于好动的男孩，多为单侧性。